厚朴酚的结构类型是
A. 蒽醌类
B. 木脂素
C. 二萜类
D. 香豆素类
E. 二氢黄酮类

正确答案：B。木脂素

解析：本题考查的是厚朴酚的结构。厚朴酚的结构类型是木脂素（B对）。厚朴酚为厚朴的主要化学成分。厚朴中主要化学成分为木脂素类化合物，包括厚朴酚以及和厚朴酚等，《中国药典》采用高效液相色谱法测定药材中厚朴酚与和厚朴酚含量，两者总含量不得少于2.0%。蒽醌类（A错）：蒽醌类成分包括蒽酮及其不同还原程度的产物。主要有大黄素、大黄酚、茜草素、番泻苷等。二萜类（C错）：二萜是指骨架由4个异戊二烯单位构成，含20个碳原子的一类萜类衍生物。绝大多数不能随水蒸气蒸馏。二萜多以树脂、内酯或苷等形式广泛存在于自然界。不少二萜含氧衍生物具有很好的生物活性，如穿心莲内酯、芫花酯、雷公藤内酯、银杏内酯、紫杉醇等。香豆素类（D错）：香豆素是邻羟基桂皮酸的内酯，广泛分布于高等植物中，尤其以芸香科和伞形科为多见，少数发现于动物和微生物中。含香豆素的常用中药有秦皮、前胡、肿节风、补骨脂等。在植物体内，它们往往以游离状态或与糖结合成苷的形式存在。如补骨脂内酯、白芷内酯、花椒内酯、邪蒿内酯等。二氢黄酮类（E错）属于黄酮类化合物。黄酮类化合物广泛存在于自然界中，多存在于高等植物及羊齿类植物中。苔类中含有的黄酮类化合物为数不多，而藻类、霉菌、细菌中没有发现黄酮类化合物。如黄芩苷、黄芩素、大豆素、葛根素、芦丁、槲皮素、橙皮苷等。